不属病毒感染类型的是
A. 慢性病毒感染
B. 慢发病毒感染
C. 潜伏性感染
D. 败血症
E. 隐性感染

正确答案：D。败血症